新生儿病理性黄疸的特点是
A. 生后24小时内出现黄疸
B. 足月儿2周内消退
C. 早产儿3～4周内消退
D. 血清胆红素8～10mg/dl
E. 血清结合胆红素1mg/dl左右

正确答案：A。生后24小时内出现黄疸

解析：病理性黄疸的特点可以概括为“出现早、进展快、持续时间长”。具体特点如下：1.生后24小时内出现黄疸（A对）；2.血清胆红素足月儿＞221μmol/L（12.9mg/dl）、早产儿＞257μmol/L（15mg/dl）（D错），或每日上升＞85μmol/L（5mg/dl）；3.黄疸持续时间足月儿＞2周（B错）、早产儿＞4周（C错）；4.黄疸退而复现；5.血清结合胆红素＞34μmol/L（2mg/dl）（E错）。